患者，女，29岁，孕29+6周，血压160/100mHg，尿蛋白(-），该患者降压药应选用
A. 氨氯地平
B. 甲基多巴
C. 卡托普利
D. 厄贝沙坦
E. 哌唑嗪

正确答案：B。甲基多巴

解析：本题考查妊娠期高血压用药。患者，女，29岁，孕29+6周，血压160/100mHg，尿蛋白(-），该患者降压药应选用甲基多巴（B对）。妊娠期高血压常用的药物有硫酸镁、甲基多巴、拉贝洛尔、美托洛尔、氢氯噻嗪及硝苯地平。以二氢吡啶类CCB（地平类）（A错）为基础的降压治疗方案可显著降低高血压患者脑卒中风险；尤其适用于老年高血压，单纯收缩期高血压，伴稳定型心绞痛、冠状动脉或颈动脉粥样硬化及周围血管疾病患者。ACEI（普利类）（C错）尤其适用于伴慢性心力衰竭、心肌梗死后心功能不全、心房颤动、糖尿病肾病、慢性肾脏病、代谢综合征、蛋白尿或微量白蛋白尿的患者。ARB（沙坦类）（D错）尤其适用于伴左心室肥厚、心力衰竭、糖尿病肾病、冠心病、代谢综合征以及不能耐受ACEI的患者。α受体阻断剂（唑嗪类）（E错）不作为高血压治疗的首选药，适用于高血压伴前列腺增生症患者，也用于难治性高血压患者的治疗。